阴偏衰所致的证候是
A. 实热证
B. 虚热证
C. 实寒证
D. 虚寒证
E. 寒热错杂证

正确答案：B。虚热证

解析：形成阴虚的主要原因，多由于阳邪伤阴，或因五志过极，化火伤阴，或久病伤阴所致液亏虚，主要表现为凉润、抑制与宁静的功能减退，阴不能制约阳，阳气相对偏亢，形成阴虚内热、阴虚火旺、阴虚阳亢等多种病变（B对）。阴虚可见于五脏六腑，如肺阴、脾阴、胃阴、心阴、肝阴和肾阴，皆可发生阴虚病变，但一般以肾阴亏虚为主。肾阴为人身诸阴之本，所以肾阴不足在阴偏衰的病机中占有极其重要的地位。